女，45岁。G₂P₁，继发性痛经6年。查体：子宫如妊娠12周大小，质硬，活动受限。药物治疗后症状无缓解。最佳手术治疗方案是
A. 子宫切除术
B. 广泛性子宫切除术
C. 改良广泛性子宫切除术
D. 子宫切除加双附件切除术
E. 骶神经切断术

正确答案：A。子宫切除术

解析：该患者为中年经女性，G2P1（孕2产1，子宫腺肌病多发生于30～50岁经产妇），继发性痛经6年，妇检：子宫增大，质硬，活动受限，药物治疗后症状无缓解（主要症状为进行性痛经，妇检子宫呈均匀增大或有局限性结节隆起，质硬且有压痛），应考虑为子宫腺肌病。该患者症状严重、无生育要求且药物治疗无效，故最佳手术方案是子宫切除术（A对）。因子宫腺肌病病灶在子宫，不需切除卵巢及其他附件，故广泛性子宫切除术（B错）、改良广泛性子宫切除术（C错）、子宫切除加双附件切除术（D错）不适用于子宫腺肌病。骶神经切断术（E错）适用于治疗子宫内膜异位症引起的慢性盆腔痛。